外阴皮损处分泌物涂片，适用于暗视野显微镜观察的病原体是
A. 人乳头瘤病毒
B. 单纯疱疹病毒
C. 苍白密螺旋体
D. 巨细胞病毒
E. 淋病奈瑟菌

正确答案：C。苍白密螺旋体

解析：暗视野显微镜下，典型的梅毒螺旋体呈白色发光，其螺旋体较密而均匀，其运动方式包括旋转式、蛇形式、伸缩移动。此检查对梅毒有病原学诊断的价值（九版传染病学P251）。